细菌产生耐药性的主要原因之一是
A. F质粒转移
B. R质粒转移
C. Col质粒转移
D. 毒力质粒转移
E. 代谢质粒转移

正确答案：B。R质粒转移

解析：R质粒转移是细菌产生耐药性的主要原因之一。在人体内，一种细菌可带有多种质粒，而一种耐药质粒（R质粒）又可携带多种耐药性基因群，并可通过接合、转化、转导、转位易位及整合等多种的基因转移或重组形式，在细菌之间传播并可导致出现多重耐药菌株。掌握“细菌遗传变异的物质基础及机制”知识点。